下列关于方差和标准差的叙述，不正确的是
A. 方差的单位与标准差的单位相同
B. 方差的单位是标准差单位的平方
C. 都用于描述定量资料频数分布的变异程度
D. 二者值越大，说明资料的变异程度越大
E. 均适用于对称分布，特别是正态分布或近似正态分布资料

正确答案：A。方差的单位与标准差的单位相同

解析：本题考查方差和标准差的相关内容。方差是指所有观测值的离均差平方和的平均值，描述所有观测值与均数的平均偏离程度。标准差是方差的平方根。实际应用中，因为标准差的单位与原始观测值的单位一致，更多使用标准差而非方差反映数据的离散程度(A错，为本题正确答案）。解释